对狂犬病患者的正确治疗原则是
A. 用大剂量的丙种球蛋白及抗菌药物
B. 立即接种抗犬疫苗及注射免疫血清
C. 给予患者维持呼吸系统及心血管系统功能的对症治疗
D. 用大剂量抗狂犬病免疫球蛋白及输血、输血浆等支持治疗
E. 使用狂犬病免疫血清及病原治疗药物

正确答案：C。给予患者维持呼吸系统及心血管系统功能的对症治疗

解析：对狂犬病患者的正确治疗原则是给予患者维持呼吸系统及心血管系统功能的对症治疗（C对）。用大剂量的丙种球蛋白及抗菌药物（A错）、用大剂量抗狂犬病免疫球蛋白及输血、输血浆等支持治疗（D错）对狂犬病患者治疗无效。立即接种抗犬疫苗及注射免疫血清（B错）及使用狂犬病免疫血清及病原治疗药物（E错）均是预防狂犬病的措施（P108）。